产后出血的最主要的原因是
A. 子宫收缩乏力
B. 胎盘因素
C. 软产道损伤
D. 凝血功能障碍
E. 血小板计数减少

正确答案：A。子宫收缩乏力

解析：子宫收缩乏力（A对）是产后出血最主要的原因。胎盘因素（B错）包括胎盘滞留，胎盘植入，胎盘部分残留等，会导致子宫收缩不良而不能有效控制出血；软产道损伤（C错）分娩后立即出现阴道流血；凝血功能障碍（D错）包括血小板计数减少（E错）。以上四项都是产后出血的原因，但不是产后出血最常见原因。